阳偏胜的病理状态是
A. 阳气亢盛，机能亢奋，热量过剩
B. 阳气亢盛，耗伤机体的阴液
C. 阴液不足，阳气失制而偏盛
D. 阴寒之邪盛于内，逼迫阳气浮越于外
E. 以上均非

正确答案：A。阳气亢盛，机能亢奋，热量过剩

解析：阳偏胜，即是阳盛，指机体在疾病过程中所出现的阳邪偏盛、功能亢奋、机体反应性增强而产生热象的病机变化（A对）；阳气亢盛，耗伤机体的阴液是指阳邪偏盛伤及机体的阴液，即所谓的“阳盛则阴病”（B错）；阴液不足，阳气失制而偏盛是指阴偏衰的病理状态，阴液不足，阴不制阳从而阳气相对偏盛（C错）；阴寒之邪盛于内，逼迫阳气浮越于外是阴盛格阳的病理状态（D错）。